胃溶型薄膜衣包衣过程应选择的材料
A. 丙烯酸树脂Ⅱ号
B. 羟丙基甲基纤维素
C. 玉米朊乙醇溶液
D. 滑石粉
E. 川蜡

正确答案：B。羟丙基甲基纤维素

解析：本题考查片剂的包衣。胃溶型薄膜衣包衣过程应选择的材料是羟丙基甲基纤维素（B对）。包衣的基本类型包括糖包衣、薄膜包衣和压制包衣等。薄膜包衣可用高分子包衣材料，包括胃溶型、肠溶型和水不溶型三大类。胃溶型主要有羟丙基甲基纤维素、甲基纤维素等；肠溶型主要有虫胶、醋酸纤维素酞酸酯（CAP）、丙烯酸树脂类（Ⅰ、Ⅱ、Ⅲ类）等（A错）；糖包衣常用的材料有：玉米朊乙醇溶液（C错）、邻苯二甲酸醋酸纤维素乙醇溶液以及明胶浆等；粉衣层常用材料包括滑石粉（D错）、蔗糖粉、明胶等；糖衣层用料主要是适宜浓度的蔗糖水溶液；川蜡（E错）为打光包衣的材料。